结核病防治策略是
A. 婴幼儿卡介苗接种；封锁疫情；短程督导化疗；药物预防；切断传播途径
B. 新生儿卡介苗接种；封锁疫情；长期督导化疗；药物预防；切断传播途径
C. 婴幼儿卡介苗接种；隔离患者；短程督导化疗；药物预防；切断传播途径
D. 新生儿卡介苗接种；病例发现；短程督导化疗；药物预防；切断传播途径
E. 新生儿卡介苗接种；病例发现；长期督导化疗；药物预防；切断传播途径

正确答案：D。新生儿卡介苗接种；病例发现；短程督导化疗；药物预防；切断传播途径